X射线衍射的布拉格方程中，d（hkl）为
A. 某一点阵面的晶面间距
B. X射线的波长
C. 衍射角
D. 衍射强度
E. 晶格中相邻的两质点之间的距离

正确答案：A。某一点阵面的晶面间距